《国务院关于整合城乡居民医疗保险制度的意见》要求整合城镇居民基本医疗保险和新型农村合作医疗制度，建立统一的城乡居民基本医疗保险制度。关于我国整合城乡居民基本医疗保险制度重点内容的说法，错误的是
A. 坚持统一覆盖范围和保障待遇，均衡城乡居民的保障待遇
B. 统一居民医保基金管理制度，遵循以收定支、收支平衡，略有结余原则
C. 坚持统一筹资渠道和筹资水平，统一住院费用支付比例
D. 统一城乡居民医保药品目录和医疗服务项目目录，对目录实行分级管理、动态调整

正确答案：C。坚持统一筹资渠道和筹资水平，统一住院费用支付比例

解析：本题考查我国整合城乡居民基本医疗保险制度重点内容。我国整合城乡居民基本医疗保险的重点内容:（1）统一覆盖范围，城乡居民医保制度覆盖范围包括现有城镇居民医保和新以外的其他所有城乡居即覆盖除织民。（2）统一筹资政策，坚持多渠道筹资，继实行个人费与政府补助相结合为主的筹资方式，鼓励集体、单位或其他社会经济组织给予扶持或资助，在精算平衡的基础上，逐步建立与经济社会发展水平，各方承受能力相适应的稳定筹资机制逐步建立个人费标准与减乡居民人均可支图收入相俗接的机制。合理划分政府与个人的筹资责任，在提高政府补助标准的同时，适当提高个人缴费比重（C错，为本题正确答案）。（3）统一保障待遇。①遵循保适度、收支平衡的原则，均衡城多保障待遇，逐步统一保范围和支付标准，为参保人员提供公平的基本医疗保障（A对）；②城多居民医保基金主要用于支付参保人员发生的住院和门诊医药费用；③稳定住院保障水平，政策范围内住院费用支付比例保持在75%左右。（4）统一医保目录，统一城乡居民医保药品目录和医疗服务项目目录（D对），明确药品和医疗服务支付范围，各省(区、市)要按照国家基本医保用药管理和基本药物制度有关规定，遵循临床必票安全有效、价格合理，技术活宜、其全可承受的原则，在现有城镇居民医保和新农合目录的其出上，活当老电参保人员重求变化进行调整，有增有减、有控有扩，做到种类基本齐全、结构总体合理。完善医保目录管理办法，实行分级管理、动态调整。（5）统一定点管理，统一城乡居民医保定点机构管理办法，强化定点服务协议管理，建立健全考核评价机制和动态的准入退出机制，对非公立医疗机构与公立医宁机构实行同等的定点管理政策，原则上由统筹地区管理机构负责定点机知的准入、退出和监管，省级管理机私负责制J定点机构的准入原则和管理办法，并重点加强对统筹区域外的省、市级定点医疗机构的指导与监督。（6）统一基金管理，城乡居民医保执行国家统一的基金财务制度、会计制度和基金预决算管理制度.城乡居民医保基金纳入财政专户，实行“收支两条线”管里。基全独立核算、专户管理，任何单位和个人不得挤占挪用。其全使用遵循以收定支收古平衡略有结余的原则，确保应支付费用及时足额拨付，合理控制基全当年结余率和累计结余率（B对）。